以上药物属于“探亲药”的避孕药物是
A. 复发甲地孕酮片
B. 复方左旋18甲长效避孕片
C. 53号抗孕片
D. 更炔诺酮注射液
E. 甲硅环

正确答案：C。53号抗孕片

解析：53号抗孕片属于口服避孕药中的“探亲药”。掌握“激素避孕”知识点。